患者恶寒发热，头重身疼，无汗，腹痛吐泻，胸脘痞闷，舌苔白腻，脉浮治宜选用
A. 清暑益气汤
B. 生脉散
C. 银翘散
D. 白虎汤
E. 香薷散

正确答案：E。香薷散

解析：“患者恶寒发热，头身疼痛，无汗”提示外感风寒；“腹痛吐泻，胸脘痞闷”此为暑令内伤于寒湿，湿伤脾胃，气机受阻，升降失常；“舌苔白腻”为寒湿之象，此为外寒内湿之证，治当发散表寒、祛除里湿，方用香薷散（E对）。重用香薷为君药，入肺胃经，芳香质轻，辛温发散，为夏月祛暑解表要药；厚朴苦辛性温，行气除满，燥湿运脾，为臣药；白扁豆甘淡性平，健脾和中，渗湿消暑，为佐药。清暑益气汤功用为清暑益气，养阴生津，主治暑热气津两伤证（A错）。生脉散功用为益气生津，敛阴止汗，主治温热、暑热伤气耗阴证（B错）。银翘散功用为辛凉透表，清热解毒，主治温病初起（C错）。白虎汤功用为清热生津，主治气分热盛证（D错）。